红斑的病理变化不包括
A. 原位癌
B. 早期浸润癌
C. 上皮萎缩
D. 上皮不典型增生
E. 上皮单纯性增生

正确答案：E。上皮单纯性增生

解析：病理变化：口腔粘膜的红斑虽然不如白斑多见，但在组织学上其恶性者所占的比例却很高。均质型红斑在镜下有的表现为上皮萎缩，有的为上皮异常增生或原位癌。颗粒型红斑大多为原位癌或已经突破基底膜的早期浸润癌，只有少数为上皮异常增生，这种类型的癌可以面积较大，也有的表现为多中心性生长。颗粒型形成的机理，就是上皮钉突增大处的表面形成凹陷，而高突的结缔组织乳头形成红色颗粒。红斑的表面上皮由不全角化层覆盖，钉突之间的上皮萎缩变薄，结缔组织中血管增生且扩张充血，因此临床表现为红斑。掌握“口腔白斑、红斑病”知识点。